引起精神障碍的的因素有
A. 心理因素产生作用
B. 生物因素和心理因素共同作用
C. 社会因素和生物因素共同作用
D. 生物因素和社会因素共同作用
E. 生物、心理和社会因素共同作用

正确答案：E。生物、心理和社会因素共同作用

解析：现代医学和心理学研究发现，精神障碍与其他躯体疾病一样，均是生物、心理、社会（文化）因素相互作用的结果。掌握“精神障碍概述”知识点。